可待因是前药，需经肝药酶转化为吗啡而发挥镇痛作用，参与转化的肝药酶是
A. CYP1A2
B. CYP3A4
C. CYP2C9
D. CYP2D6
E. CYP2C19

正确答案：D。CYP2D6

解析：本题考查可待因的转化。可待因是前药，约15%经CYP2D6（D对）代谢为吗啡发挥作用。